某女，60岁。素体虚弱，气短乏力，面色萎黄，身痛肢麻。近日又见失眠多梦，据此医师以补气养血，养心安神为主。并在处方中重用了夜交藤，此因夜交藤除养心安神外，又能
A. 息风通络
B. 化痰通络
C. 祛风通络
D. 镇惊通络
E. 祛湿通络

正确答案：C。祛风通络

解析：本题考查的是夜交藤的功效。夜交藤除养心安神外，又能祛风通络（C对）。夜交藤：【功效】养心安神，祛风通络。天麻：【功效】息风止痉，平抑肝阳，祛风通络（A错）。穿山龙：【功效】祛风除湿，活血通络（E错），化痰（B错）止咳。功效为镇惊通络（D错）的中药，2022年考试指南未明确说明。